输血前医务人员应严格核对那些内容
A. 血型
B. 配血单和血袋标签中的各项内容
C. 配血单有无空项
D. 血袋包装
E. 人员名单

正确答案：B。配血单和血袋标签中的各项内容

解析：输血前由两名医护人员核对交叉配血报告单及血袋标签各项内容，检查血袋有无破损渗漏，血液颜色是否正常。准确无误方可输血。掌握“医疗机构临床用血管理、及法律责任”知识点。